参与DNA转录的酶是
A. DNA聚合酶
B. 核酶
C. RNA聚合酶
D. 限制性内切核酸酶
E. DNA连接酶

正确答案：C。RNA聚合酶

解析：生物体以DNA为模板合成RNA的过程称为转录。故转录过程为RNA的合成过程，而RNA聚合酶可按碱基配对规律催化核苷酸聚合为RNA。参与DNA转录的酶是RNA聚合酶。掌握“辅酶与酶促反应”知识点。